银柴胡的功效有
A. 退虚热
B. 除湿热
C. 解暑热
D. 清疳热
E. 透表热

正确答案：A、D。退虚热；清疳热

解析：本题考查的是银柴胡的功效。银柴胡的功效有退虚热（A对），清疳热（D对）。银柴胡：【功效】退虚热，清疳热。胡黄连：【功效】退虚热，除疳热，清湿热（B错），解热毒。青蒿：【功效】退虚热，凉血，解暑（C错），截疟。白薇：【功效】退虚热，凉血清热，利尿通淋，解毒疗疮。白薇既透营分热，又透阴分伏热，还透解表热（E错）。